牙齿缺失，位于缺牙远中的邻牙因近中支持丧失，在向前的推动力作用下将向
A. 舌侧移动
B. 远中移动
C. 近中移动
D. （唇）颊侧移动
E. 以上都不对

正确答案：C。近中移动

解析：牙列及其（牙合）关系的建立和最终的稳定，从前后方向看取决于向前、向后力的平衡点位置。如果牙齿缺失，位于缺牙远中的邻牙因近中支持丧失，在向前的推动力作用下将向近中移动或倾斜，而位于缺牙近中的邻牙也会因缺少远中支持，在（牙合）力的作用下向远中移动或倾斜。掌握“（牙合）的生长发育”知识点。